肾病综合征患者高度水肿，尿量400～500ml/d，持续2周，尿蛋白（++++），血浆蛋白20g/L，肌酐清除率为100ml/min，本患者的治疗主要是
A. 速尿
B. 消炎药
C. 输血浆或清蛋白
D. 肾上腺皮质激素
E. 血液透析

正确答案：D。肾上腺皮质激素

解析：肾病综合征患者高度水肿，尿量400～500ml/d（尿量正常偏少），持续2周，尿蛋白（++++），血浆蛋白20g/L，肌酐清除率为100ml/min（正常范围，提示肾功能正常），本患者的治疗主要为肾上腺皮质激素（D对），对肾病综合征的治疗，目前糖皮质激素和细胞毒药物仍为主要药物，原则上根据肾脏活检病理结果选择治疗药物及确定疗程。通常在激素治疗时候无需应用抗生素预防感染，否则不仅达不到预防感染的目的，反而可能诱发真菌二重感染（B错）。速尿（A错）为袢利尿剂，为对症治疗，注意用药不宜过快过猛，防止造成血容量不足、加重血液高黏滞，诱发血栓（栓塞）并发症。血液透析（E错）为肾病综合征并发急性肾损伤时的治疗措施，同时应补充血浆制品（C错），此时需适当脱水，减轻肾间质水肿。